男，63岁。晨起发现言语不清，右侧肢体活动不适，既往体健。发病后5小时体检神志清楚，血压120/80mmHg，右中枢性面瘫，舌瘫，右侧上下肢体肌力2级，右半身痛觉减退。头颅CT未见异常。病变的部位可能是
A. 左侧大脑前动脉
B. 右侧大脑前动脉
C. 左侧大脑中动脉
D. 右侧大脑中动脉
E. 椎-基底动脉

正确答案：C。左侧大脑中动脉

解析：患者老年男性，病程短，晨起起病，有前驱症状，起病急进展快，起病5小时即发生右侧偏瘫及偏身感觉障碍，患者既往体健，考虑左侧大脑中动脉（C对D错）主干血栓形成可能性大【大脑中动脉主干闭塞的表现：导致三偏症状，即病灶对侧偏瘫（包括中枢性面舌瘫和肢体瘫痪）、偏身感觉障碍及偏盲】。脑梗死时头颅CT检查应在24-48小时才能显示出梗死灶，该患者发作5小时，故头颅CT检查正常。大脑前动脉（AB错）病变会出现截瘫、二便失禁、意志缺失、运动性失语综合征和额叶人格改变等表现（P178）。椎-基底动脉（E错）病变会出现眩晕、呕吐、四肢瘫痪、共济失调、肺水肿、消化道出血、昏迷和高热等表现（P178）。